提示小儿缺氧的胎动计数是
A. 胎动：＜5次/2小时
B. 胎动：＜7次/2小时
C. 胎动：＜8次/2小时
D. 胎动：＜10次/2小时
E. 胎动：＜12次/2小时

正确答案：D。胎动：＜10次/2小时

解析：可能胎动计数是胎动监测是评价胎儿宫内情况最简便有效的方法之一。根据九版妇产科学：若胎动计数≥10次/2小时为正常，＜10次/2小时或减少50％者提示胎儿缺氧可能（D对）。